属于天然高分子成囊材料的是
A. 羧甲基纤维素钠
B. 乙基纤维素
C. 聚乳酸
D. 甲基纤维素
E. 海藻酸盐

正确答案：E。海藻酸盐

解析：本题考查药物微囊化的材料。常用的囊材可分为天然的、半合成或合成的高分子材料三大类：（1）天然高分子囊材：明胶、阿拉伯胶、海藻酸盐（E对）、壳聚糖。（2）半合成高分子囊材：羧甲基纤维素盐（A错）、醋酸纤维素酞酸酯（CAP）、乙基纤维素（EC）（B错）、甲基纤维素（MC）（D错）、羟丙甲纤维素（HPMC）。（3）合成高分子囊材：聚碳酯、聚氨基酸、聚乳酸（PLA）（C错） 、丙交酯乙交酯共聚物、聚乳酸-聚乙二醇嵌段共聚物等。